初产妇总产程不超过
A. 16小时
B. 18小时
C. 20小时
D. 22小时
E. 24小时

正确答案：E。24小时

解析：总产程指从开始出现规律宫缩直到胎儿胎盘娩出的全过程，超过24小时称为滞产，故初产妇总产程不超过24小时（E对）。